RPA卡环组包括
A. 近中（牙合）支托、远中邻面板和杆型卡环
B. 远中（牙合）支托、近中邻面板和圆环形卡环
C. 近中（牙合）支托、远中邻面板和圆环形卡环
D. 远中（牙合）支托、远中邻面板和圆环形卡环
E. 近中（牙合）支托、近中邻面板和圆环形卡环

正确答案：C。近中（牙合）支托、远中邻面板和圆环形卡环

解析：RPA卡环组包括近中（牙合）支托、远中邻面板和圆环形卡环固位臂。掌握“局部义齿固位体”知识点。